描述上颌窦正确的是
A. 在上颌骨体内
B. 窦顶为颧弓
C. 底通口腔
D. 窦口低于窦底部
E. 开口于下鼻道

正确答案：A。在上颌骨体内

解析：上颌窦位于上颌骨的上颌体内（A对）。窦顶为眶下壁（B错），底为上颌骨牙槽突（C错），与第 1 、2 磨牙及第 2 前磨牙紧邻 ，窦口高于窦底（D错），故窦内积液时直立位不易引流。